右侧阴囊内肿块，质硬，无触痛，有沉重感，透光试验阴性。最可能的疾病是
A. 睾丸鞘膜积液
B. 交通性鞘膜积液
C. 精囊结核
D. 附睾结核
E. 睾丸肿瘤

正确答案：E。睾丸肿瘤

解析：患者右侧阴囊内肿块，质硬，无触痛，有沉重感，透光实验阴性（睾丸肿瘤患侧睾丸增大或扪及肿块，质地较硬，与睾丸界限不清，用手托起较正常侧沉重感，透光试验阴性），所以应最先考虑睾丸肿瘤（E对）。睾丸鞘膜积液（A错）呈球形或卵圆形，表面光滑，有弹性和囊样感，无压痛，触不到睾丸和附睾，透光实验阳性（P581）。交通性鞘膜积液（B错），立位时阴囊肿大，卧位时积液流入腹腔，鞘膜囊缩小或消失，睾丸可触及。男性生殖系统结核大多继发于肾结核，一般来自后尿道感染，少数有血行直接播散所致，该患者无结核病史（CD错）（P548）。